鼻咽与鼓室相连的小管是
A. 内耳道
B. 外耳道
C. 耳蜗
D. 蜗螺旋管
E. 咽鼓管

正确答案：E。咽鼓管

解析：咽鼓管为连通鼻咽部与鼓室的通道（E对）。